职业卫生监督执法人员履行职责时，不得有下列行为，但除外
A. 泄露用人单位和秘密
B. 出示监督执法证件
C. 对不符合法定条件的，发给建设项目有关证明文件资质证明文件或者予以批准
D. 对已经取得有关证明文件的，不履行监督检查职责
E. 发现用人单位存在职业病危害的，可能造成职业病危害事故，不及时依法采取控制措施

正确答案：B。出示监督执法证件